不可复性关节盘移位伴张口受限，但时间较短者可使用
A. 关节镜治疗
B. 泼尼松龙混悬液+2%利多卡因关节腔注射
C. 复位牙合板治疗
D. 0.5%或1%利多卡因局部封闭
E. 2%利多卡因关节腔内注射后手法复位

正确答案：E。2%利多卡因关节腔内注射后手法复位

解析：本题考查颞下颌关节紊乱病的治疗。不可复性关节盘移位伴张口受限，但时间较短者可使用2%利多卡因关节腔内注射后手法复位（E对）。不可复性盘前移位：关节盘前移位在开口运动时，不能恢复正常位置，不能恢复正常的髁突-关节盘关系。对不可复性盘前移位伴开口受限时间较短者，一般于2%利多卡因2ml关节腔内注射后，采用简单的手法复位可使之开口度恢复正常。0.5%或1%利多卡因局部封闭（D错）为翼外肌功能亢进治疗首选。